B型血
A. 红细胞膜上含A凝集原、血清中含抗A凝集素
B. 红细胞膜上含B凝集原、血清中含抗B凝集素
C. 红细胞膜上含A凝集原、血清中含抗B凝集素
D. 红细胞膜上含B凝集原、血清中含抗A凝集素
E. 红细胞膜上同时含有A和B两种凝集原，血清中无凝集素

正确答案：D。红细胞膜上含B凝集原、血清中含抗A凝集素